心脏病孕妇容易发生心衰的时期是
A. 妊娠20～22周
B. 妊娠24～26周
C. 妊娠28～30周
D. 妊娠32～34周
E. 妊娠36～38周

正确答案：D。妊娠32～34周

解析：孕妇的总血容量较非妊娠期增加，一般自妊娠第6周开始，32～34周（D对）达高峰。此时血容量较妊娠前增加30％～45％，心脏负荷最大，最易发生心力衰竭。